肺的外形和结构,不正确的有
A. 肺左、右各一，位于胸腔内
B. 右肺粗大,为3叶，左肺狭长,有2叶
C. 肺上端尖锐称肺尖，突入颈根部
D. 内侧面邻纵隔，又称纵隔面
E. 左肺前缘有一明显的弧形陷凹，称心切迹

正确答案：C。肺上端尖锐称肺尖，突入颈根部

解析：肺左、右各一，位于胸腔内（A对）。右肺粗大, 为3叶，左肺狭长, 有2叶（B对）。肺尖即肺的上端，钝圆，经胸廓上口突入颈根部（C错，为本题正确答案）。肺内侧面邻纵隔，又称纵隔面（D对）。左肺前缘有一明显的弧形陷凹，称心切迹（E对）。